恶性肿瘤的生物治疗有望在不久的将来，成为继手术化疗、放疗之后的第四种疗法。从广义上讲，它包括
A. 细胞因子治疗
B. 基因治疗
C. 免疫治疗
D. A+B
E. A+B+C

正确答案：E。A+B+C

解析：生物治疗：基础是千方百计调动机体本身的抗癌功能，以自身功能调节的方式达到消灭残余癌瘤（亚临床灶），并达到临床治愈的目的。因此，生物疗法被普遍看好，并有望在不久的将来，能常规地作为癌瘤的第四种疗法。从广义来说，生物治疗应包括免疫治疗、细胞因子治疗、基因治疗等。掌握“口腔颌面部肿瘤的治疗原则及预防”知识点。